根据唇腭裂序列治疗原则，腭瘘修复的时间是
A. 6个月
B. 12～18个月
C. 学龄前
D. 9～12岁
E. 16岁以后

正确答案：A。6个月

解析：根据唇腭裂序列治疗原则，腭瘘修复的时间是6个月（A对）。腭瘘术后6～12个月后，再行二期手术；腭裂整复术约在8～18个月左右为宜（B错）；牙槽突裂植骨手术约9～12岁为宜（D错）；正颌外科治疗常在16岁以后进行（E错）。